男，56岁，全胃切除术后3天行肠内营养，第4天出现腹泻。分析其腹泻原因不包括
A. 营养液温度过低
B. 营养液污染
C. 小肠对脂肪耐受改变
D. 肠腔内渗透压过高
E. 营养液输注速度过慢

正确答案：E。营养液输注速度过慢

解析：全胃切除术后的患者短期内不能进食，故早期需行肠外营养，3～4天后可改为肠内营养。肠内营养液输注时应注意营养液的浓度、剂量及输注的速度等，以减少肠内营养的并发症。营养液的输注速度宜慢，以使营养液充分升温，并与肠道内的消化液充分混合，有利于营养成份的吸收，避免发生腹泻（E错，为本题正确答案）。由于营养液不经过口腔、食管等部位而直接进入肠腔，因此若营养液温度过低，可刺激肠道使肠蠕动增加，从而出现腹泻症状（A对）。若污染的营养液输入肠道，可使肠道菌群失调，肠道免疫防御功能降低，继发感染后病人可出现腹痛、腹泻等症状（B对）。全胃切除术后早期不能进食，由于缺乏食物刺激，胆汁、胰液的分泌减少，使小肠对脂肪的耐受性降低，当行肠内营养时，可引起腹泻（C对）。若营养液浓度过高、输注速度过快，行肠内营养时，肠腔内渗透压迅速增高，可使肠道内分泌细胞分泌大量血管活性物质，继而引起腹泻（D对）。